非概率抽样包括
A. 方便抽样、立意抽样、雪球抽样、分层抽样
B. 方便抽样、立意抽样、雪球抽样、系统抽样
C. 方便抽样、定额抽样、雪球抽样、分层抽样
D. 方便抽样、立意抽样、雪球抽样、定额抽样

正确答案：D。方便抽样、立意抽样、雪球抽样、定额抽样

解析：本题考查非概率抽样。常用的非概率抽样有方便抽样、立意抽样、雪球抽样、定额抽样等（D对ABC错）。